肝硬化患者，近1周来发热腹痛，腹水明显增加。腹水检查：淡黄，比重1.017，蛋白35g/L，白细胞0.5×10⁹/L，中性粒细胞为主。最可能并发
A. 结核性腹膜炎
B. 自发性腹膜炎
C. 门静脉血栓形成
D. 原发性肝癌
E. 肝肾综合征

正确答案：B。自发性腹膜炎

解析：患者有肝硬化病史，近1周出现发热、腹痛，腹水明显增加（符合自发性腹膜炎的特点）。腹水常规：腹水检查：淡黄，比重1.017，蛋白35g/L（＞30g/L），白细胞0.5×10⁹/L（500×10⁶/L），中性粒细胞为主，提示腹水为渗出液。综合患者病史、临床表现与腹水检查，考虑诊断为自发性细菌性腹膜炎（B对）。结核性腹膜炎（P370）（A错）腹水多为草黄色渗出液，白细胞以淋巴细胞或单核细胞为主。门静脉血栓形成（P409）（C错）急性或亚急性发展时，表现为中、重度腹胀痛或突发剧烈腹痛、脾大、顽固性腹水、肠坏死、消化道出血及肝性脑病等，腹穿可抽出血性腹水。原发性肝癌（P416）（D错）表现为肝区疼痛、肝大、黄疸、肝硬化征象、进行性消瘦、发热、食欲不振、乏力、营养不良和恶病质等，其腹水一般呈漏出液表现。肝肾综合征（P409）（E错）临床主要表现为少尿、无尿及氮质血症。